服用后易出现呃逆、腹胀和嗳气，甚至引起反跳性胃酸分泌增加的药物是
A. 奥美拉唑
B. 胶体果胶铋
C. 替普瑞酮
D. 复方碳酸钙
E. 法莫替丁

正确答案：D。复方碳酸钙

解析：本题考查复方碳酸钙。服用后易出现呃逆、腹胀和嗳气，甚至引起反跳性胃酸分泌增加的药物是复方碳酸钙（D对）。碳酸氢钠、碳酸钙因释放二氧化碳，可出现呃逆、腹胀和嗳气，引起反跳性胃酸分泌增加。老年患者长期大剂量使用奥美拉唑（A错）可引起骨折。服用胶体果胶铋（B错）颗粒或胶体果胶铋干混悬剂，偶可出现恶心、便秘等消化道症状。替普瑞酮（C错）的不良反应有肝功能障碍及黄疸等。服用法莫替丁（E错），少数患者可有口干，头晕、失眠、便秘、腹泻皮疹、面部潮红、白细胞减少，偶有轻度一过性转氨酶增高等。